济川煎的组成药物中不含
A. 升麻
B. 牛膝
C. 麦冬
D. 枳壳
E. 泽泻

正确答案：C。麦冬

解析：本题考查方剂的组成，济川煎组成有当归、牛膝、肉苁蓉、泽泻、升麻、枳壳没有麦冬（C对）。